下列有关局麻药的作用机制，说法不正确的是
A. 提高产生神经冲动所需的阈电位
B. 延长动作电位的不应期
C. 抑制动作电位去极化上升的速度
D. 提高神经细胞传导性
E. 使神经细胞丧失兴奋性

正确答案：D。提高神经细胞传导性

解析：局麻药可作用于神经，提高产生神经冲动所需的阈电位，抑制动作电位去极化上升的速度，延长动作电位的不应期，甚至使神经细胞丧失兴奋性及传导性。掌握“局麻药”知识点。